下列关于初乳的叙述，错误的是
A. 呈淡黄色，含有丰富的脂质
B. 含蛋白质多
C. 含乳糖较少
D. 含β胡萝卜素多
E. 含大量免疫抗体，如分泌型1gA

正确答案：A。呈淡黄色，含有丰富的脂质

解析：一般把生后2～3天以内的乳汁称作初乳，黏稠，呈淡黄色，初乳含乳铁蛋白最高，有丰富的脂肪酸，不是脂质（A错，为本题正确答案）。含大量蛋白（B对），大量免疫抗体lgA（E对），大量β胡萝卜素（D对），少量乳糖（C对）。